男性，50岁。急性心肌梗死第2天，少尿，血压80/50mmHg，烦躁不安，面色苍白，表情淡漠，皮肤湿冷，大汗淋漓，脉细弱无力。应首先考虑的是
A. 左心衰竭
B. 急性肾衰竭
C. 心肌梗死后综合征
D. 低血糖反应
E. 心源性休克

正确答案：E。心源性休克

解析：心源性休克为心力衰竭的表现，其主要表现为持续性低血压，收缩压降至90mmHg以下，组织出现低灌注状态，可有皮肤湿冷、苍白和紫绀，出现紫色条纹，心动过速＞110次/分，尿量显著减少，意识障碍（E对）。左心衰竭的表现为（1）呼吸困难包括劳力性呼吸困难，端坐呼吸，夜间阵发性呼吸困难。（2）咳嗽、咳痰、咯血等（A错）。如心脏骤停时间较长或复苏后持续低血压，易并发急性肾衰竭，尤其多见于原有肾脏疾病的老年患者（B错）。心肌梗死后综合征心肌梗死后数周至数月内出现，可反复发生表现为心包炎、胸膜炎或肺炎，有发热、胸痛等症状，可能为机体对坏死物质的过敏反应（C错）。低血糖反应是指患者具有低血糖的症状，比如心慌、出汗、头晕、乏力等（D错）。